为将塑化液导入充满根管，操作上应注意
A. 将塑化液反复导入、吸出3、4次
B. 导入器械提插震荡
C. 导入器械必须进入根管的根尖1/3处
D. 隔离口水，干燥髓腔
E. 以上都应注意

正确答案：E。以上都应注意

解析：本题考查牙髓塑化治疗。牙髓塑化治疗是指将根管内部分牙髓抽出，不必进行扩大根管等复杂的操作步骤，而将配制好的塑化液注入根管内，与牙髓组织聚合一体，达到消除病源刺激物的作用。为此必须将塑化液导入充满根管，操作中应注意将塑化液反复导入、吸出3、4次（A对）以置换出更多的原根管内的残剩物、导入器械提插震荡（B对）以利根管内空气排出及塑化剂进入、导入器械必须进入根管的根尖1/3处（C对）使少量残髓得以包埋和固定、隔离口水，干燥髓腔（D对）防止污染塑化剂，继发感染。（ABCD均对，故E为本题的正确答案）。